女，68，左上肺肿块，糖尿病10年，高血压3年，血压180/110mmHg，拟手术，错误的是
A. 降糖治疗到5.1～11mmol/L
B. 观察病情
C. 暂停手术
D. 快速降压到正常
E. 不可以快速降压到正常

正确答案：D。快速降压到正常

解析：禁食病人需静脉输注葡萄糖加胰岛素维持血糖轻度升高状态（5.6—11.2mmol/L）（A对）。血压过高者大于180/100mmHg。术前应选用合适的降压药物，使血压平稳在一定水平，但不要求降至正常后才做手术（E对D错，为本题正确答案）。根据题干患者血压180/110mmHg，需要用降压药观察病情以及需要暂停手术（BC对）。